下列医院感染监测指标中，以一定时期内医院感染总病例数为分子的是
A. 医院感染发生率
B. 医院感染续发率
C. 医院感染患病率
D. 医院感染漏报率
E. 医院感染例次发生率

正确答案：C。医院感染患病率